在城市或区域性大气污染防制中，合理的规划不包括
A. 避免在山谷内建立有废气排放的工厂
B. 将工业区配置在当地最小风向频率的下风侧
C. 工业企业与居民区之间设置一定的卫生防护距离
D. 完善城市绿化系统
E. 加强居住区内局部污染源的管理

正确答案：B。将工业区配置在当地最小风向频率的下风侧

解析：本题考查大气污染的防治措施。大气污染的防治措施包括：一、规划措施：1.合理安排工业布局，调整工业结构：应结合城镇规划，全面考虑工业布局。工业建设应多设在小城镇和工矿区，较大的工业城市最好不再新建大型工业企业，特别是污染重的冶炼、石油和化工等企业。 如果必须要建，一定要建在远郊区或发展卫星城市。避免在山谷内建立有废气排放的工厂（A对）。应考虑当地长期的风向和风速资料，将工业区配置在当地最小风向频率的上风侧（B错，为本题正确答案），这样工业企业排出的有害物质被风吹向居住区的次数最少。由于风向经常变化，工业企业生产过程中还可能发生事故性排放，因此在工业企业与居民区之间应设置一定的卫生防护距离（C对）；2.完善城市绿化系统（D对）；3.加强居住区内局部污染源的管理（E对）。二、工艺和防护措施：1.改善能源结构，大力降低能耗；2.控制机动车尾气污染；3.改进生产工艺，减少废气排放。